五味子的主产地区是
A. 华东
B. 华南
C. 西南
D. 西北
E. 东北

正确答案：E。东北

解析：本题考查的是五味子的产地。五味子的主产地区是东北（E对）。五味子：【产地】主产于吉林、辽宁、黑龙江等省，河北亦产。主产华东（A错）的中药有南桔梗、灵芝等。华南（B错）药：主产地长江以南，南岭以北（湘、鄂、苏、赣、皖、闽等）。如茅苍术、南沙参、太子参、明党参、枳实、枳壳、牡丹皮、木瓜、乌梅、艾叶、薄荷、龟甲、鳖甲、蟾酥、蜈蚣、蕲蛇、石膏、泽泻、莲子、玉竹等。主产西南（C错）的药有灵芝、牛黄、南板蓝根等。西北（D错）药：主产地“丝绸之路”的起点西安以西的广大地区（陕、甘、宁、青、新及内蒙古西部）。如大黄、当归、秦艽、秦皮、羌活、枸杞子、银柴胡、党参、紫草、阿魏等。